直接免疫荧光染色技术，可见黏膜病变部位及相邻部位的上皮棘层细胞层呈翠绿色的网状荧光带图形，为以上哪种疾病
A. 天疱疮
B. 白斑
C. 扁平苔藓
D. 红斑
E. 良性黏膜类天疱疮

正确答案：A。天疱疮

解析：本题考查天疱疮。直接免疫荧光染色技术，可见黏膜病变部位及相邻部位的上皮棘层细胞层呈翠绿色的网状荧光带图形，为天疱疮（A对）。天疱疮采用直接免疫荧光染色技术，可见黏膜病变部位及相邻部位的上皮棘层细胞层呈翠绿色的网状荧光带图形。良性黏膜类天疱疮（E错）采用直接免疫荧光染色技术，可见黏膜病变部位的上皮基底膜区域有免疫球蛋白及补体沉淀，呈翠绿色的网状荧光带，为抗基底膜抗体阳性，为特异性诊断标志。